肋间神经
A. 共计12对
B. 是脊神经前根
C. 只含支配肋间肌的运动纤维
D. 行于肋间血管下方
E. 只含躯体感觉纤维

正确答案：D。行于肋间血管下方

解析：胸神经前支共有12对，第1-11对均位于相应的肋间隙中，称为肋间神经（A错）。脊神经前支不构成胸神经（B错）。肋间神经除含有支配肋间肌的运动纤维外，还含有分布于胸前壁的皮肤及胸膜壁层的内侧份等处的感觉纤维（CE错）。肋间神经在肋间内、外肌之间，肋间血管的下方（D对），在肋骨下缘的肋沟内前行至腋前线附近离开肋沟，续行于肋间隙的中间。